用五行说明五脏之间的制约关系，则《素问·五脏生成论》说：肺其主为
A. 胃
B. 心
C. 肝
D. 脾
E. 肾

正确答案：B。心

解析：按照五行的生克制化关系，火克金，即心克肺，所以说肺其主为心（B对）。